劳动过程是指
A. 生产工艺过程中的生产设备生产条件、使用原料和产品等
B. 劳动生产场所环境，包括自然环境和生产工艺所需人为环境及污染物等
C. 生产工艺过程中劳动者的班组、工作时间、操作体位和方式，体力和脑力劳动比例等
D. 生产工艺过程中的生产环境和劳动组织、操作体位和方式等
E. 生产工艺过程中的各种污染因素和不良环境条件等

正确答案：C。生产工艺过程中劳动者的班组、工作时间、操作体位和方式，体力和脑力劳动比例等